盐酸吗啡特征鉴别反应所采用的试剂是
A. 硫酸铜
B. 溴水和氨试液
C. 发烟硝酸和醇制氢氧化钾
D. 甲醛硫酸试液
E. 重铬酸钾

正确答案：D。甲醛硫酸试液

解析：本题考查常用的药品鉴别方法。盐酸吗啡特征鉴别反应所采用的试剂是甲醛硫酸试液（D对）。甲醛硫酸试液用于含酚羟基的异喹啉类生物碱，生成有醌式结构的有色化合物，又称为Marquis反应，是该类药物的专属鉴别反应。芳环侧链具有氨基醇结构的药物，如盐酸麻黄碱和盐酸伪麻黄碱，可与硫酸铜（A错）和氢氧化钠发生双缩脲反应，即在碱性条件下与硫酸铜形成蓝色配位化合物，水层显蓝色。氨气通入溴水（B错）中，可使其褪色。托烷类生物碱水解后生成莨菪酸，经发烟硝酸加热处理，转变为三硝基衍生物，与醇制氢氧化钾和固体氢氧化钾作用，转变为有色的醌型产物，显深紫色（C错）。重铬酸钾（E错）酸性水溶液可以检测乙醇，遇到乙醇会迅速生成蓝绿色三价离子，溶液变成灰绿色。